以预防接种为主要预防措施的肝炎是
A. 甲型肝炎、乙型肝炎、丙型肝炎
B. 甲型肝炎、乙型肝炎、丁型肝炎
C. 乙型肝炎、丙型肝炎、丁型肝炎
D. 乙型肝炎、丙型肝炎、戊型肝炎
E. 甲型肝炎、丙型肝炎、戊型肝炎

正确答案：B。甲型肝炎、乙型肝炎、丁型肝炎

解析：本题考查肝炎的主要预防措施。以预防接种为主要预防措施的肝炎是甲型肝炎、乙型肝炎、丁型肝炎（B对ACDE错）。甲型肝炎通过接种甲肝疫苗来预防，而乙型肝炎和丁型肝炎通过接种乙肝疫苗来预防。